男性，30岁，农民。既往体健。7月2日来诊，腹泻2天，为水样便带少量粘液，量多，日十余次，相继呕吐数次。无发热、无腹痛。腓肠肌痉挛。体检：体温36.8℃，神志清，皮肤弹性差，脉细速，血压70/30mmHg。化验检查：大便镜检白细胞0～2/HP，血红蛋白160g/L，血白细胞计数12×10⁹/L，中性粒细胞0.78，淋巴细胞0.12，单核细胞0.10。最可能的诊断是
A. 菌痢
B. 急性肠炎
C. 细菌性食物中毒
D. 霍乱
E. 轮状病毒感染

正确答案：D。霍乱

解析：30岁男性患者，7月份发病（霍乱流行季节），腹泻2天，为水样便带少量粘液，量多，日十余次，相继呕吐数次，无发热无腹痛（霍乱泻吐期典型表现）；腓肠肌痉挛（脱水期肌肉痉挛表现）；查体体温36.8℃，神志清，皮肤弹性差，脉细速，血压70/30mmHg（有脱水症状）；化验检查：大便镜检白细胞0～2/HP，血红蛋白160g/L（成年男性血红蛋白正常参考值120～160g/L），血白细胞计数12×10⁹/L（4～10×10⁹/L），中性粒细胞0.78（0.5～0.7），淋巴细胞0.12（正常值0.2～0.4），单核细胞0.10，根据患者的临床表现和实验室数据，最可能的诊断是霍乱（D对），其典型的临床表现为急性起病、剧烈的腹泻、呕吐，以及由此引起的脱水、肌肉痉挛，严重者导致循环衰竭和急性肾衰竭。菌痢（P178）（A错）多有不洁饮食史，常表现为腹痛腹泻，水样便或黏液脓血便，里急后重等。急性肠炎（B错）常有腹痛腹泻，无腓肠肌痉挛，无严重脱水征。细菌性食物中毒（P157）（C错）好发于夏秋季，多有不洁饮食史，常表现为急性起病，恶心呕吐，腹痛腹泻，粪便可呈水样、血水样、黏液或脓血便等。轮状病毒感染（P43）（E错）多见于6～24个月婴幼儿，好发于秋冬季，常有发热，先吐后泻，为黄色水样便或蛋花样便。